患者，女，70岁，拟行膝关节置换术，无磺胺类药过敏史，皮试结果呈阴性。体征和实验室检查：低热，无感染，空腹血糖4.6mmol/L。手术医师处方抗菌药物预防感染。围术期预防性用药宜采用的给药途径是
A. 口服
B. 肌内注射
C. 静脉滴注
D. 皮下注射
E. 动脉注射

正确答案：C。静脉滴注

解析：本题考查围术期预防性用药宜采用的给药途径。围术期预防性用药要求药物能够在短时间内尽快达到血浆峰浓度，故静脉滴注（C对）是使血药浓度上升最快的给药途径。而口服（A错）、肌内注射（B错）和皮下注射（D错）均需要吸收过程，会使达峰时间延长。一般药物不采取动脉注射（E错）给药。